儿童生长发育迟缓食欲减退或异食癖，可能缺哪种物质
A. 钙
B. 硒
C. 镁
D. 锌
E. 钠

正确答案：D。锌

解析：锌缺乏的儿童存在食欲减退、生长发育迟缓、皮炎和异食癖等临床表现（D对）。钙缺乏儿童不易入睡、不易进入深睡状态，入睡后爱啼哭、易惊醒，入睡后多汗；阵发性腹痛、腹泻，抽筋，胸骨疼痛，“X”型腿、“O”型腿，鸡胸，指甲灰白或有白痕；厌食、偏食；白天烦躁、坐立不安；智力发育迟、说话晚；学步晚，13个月后才开始学步；出牙晚，10个月后才出牙，牙齿排列稀疏、不整齐、不紧密，牙齿呈黑尖形或锯齿形；头发稀疏；健康状况不好，容易感冒等（A错）。硒缺乏儿童人体机能下降，感染高致病性病毒性疾病的危险明显增大（B错）。镁缺乏症儿童早期表现常有厌食、恶心、呕吐、衰弱及淡漠（C错）。钠缺乏的儿童轻度低钠血症时无明显临床表现。当血钠低于125mmol/L时，可出现低渗性脱水的症状，表现为眼窝和及前囟凹陷，皮肤弹性减低，心率增快，四肢厥冷，血压降低，严重者可发生休克。尿量减少或无尿。低钠严重者可因脑水肿，出现烦躁不安、呼吸暂停、嗜睡、昏迷或惊厥（E错）。需要注意的是，缺铁也同样会造成异食癖，要根据选项灵活选择。